可升高高密度脂蛋白胆固醇水平的是
A. 维生素B₂
B. 烟酸
C. 泛酸钙
D. 叶酸
E. 维生素C

正确答案：B。烟酸

解析：本题考查烟酸。可升高高密度脂蛋白胆固醇水平的是烟酸（B对）。维生素B₂（A错）为氧化还原酶的辅酶。叶酸（D错）能够降低同型半胱氨酸水平。维生素C（E错）可用于防治坏血病。